大环内酯类药物可覆盖的非典型致病菌的药物是
A. 肺炎链球菌
B. 大肠埃希菌
C. 铜绿假单胞菌
D. 军团菌
E. 厌氧菌

正确答案：D。军团菌

解析：本题考查大环内酯类抗菌药物的抗菌谱。大环内酯类抗菌药物抗菌谱包括革兰阳性球菌、革兰阴性球菌、部分革兰阴性杆菌（如流感嗜血杆菌、百日咳杆菌等）、非典型致病原（嗜肺军团菌（D对）、肺炎支原体、衣原体）和厌氧消化球菌，对产β-内酰胺酶的葡萄球菌和耐甲氧西林金黄色葡萄球菌也有一定抗菌活性。